在肌紧张反射中，脊髓前角运动神经
A. 感受器
B. 传入神经元
C. 神经中枢
D. 传出神经元
E. 效应器

正确答案：C。神经中枢

解析：肌紧张是指缓慢持续牵拉肌腱时发生的牵张反射，表现为受牵拉的肌肉处于持续、轻度的收缩状态，但不表现为明显动作。肌紧张的感受器是肌梭（A错），传入纤维是Ⅰₐ和Ⅱ类神经纤维（B错），神经中枢是脊髓前角运动神经元（C对），传出纤维是α和γ纤维（D错），效应器是慢肌纤维（E错）。